左心衰竭特有的临床表现是
A. 肝大
B. 三尖瓣关闭不全的反流性杂音
C. 下肢水肿
D. 夜间阵发性呼吸困难
E. 颈静脉充盈

正确答案：D。夜间阵发性呼吸困难

解析：左心衰竭以肺循环淤血及心排血量降低为主要表现，特有的临床表现是夜间阵发性呼吸困难（D对），是左心衰竭造成严重肺淤血的典型表现，左心衰竭引起长期肺淤血肺循环阻力增加，使右心室后负荷增加，久之可引起右心衰竭，出现肝大（A错）、下肢水肿（C错）、颈静脉充盈（E错）等右心衰竭的相关表现。左心衰竭导致的左心室扩大还可以导致相对性的二尖瓣关闭不全，产生心尖区收缩期杂音，于此相对应的，当右心衰竭导致的右心室扩大可致功能性三尖瓣关闭不全，产生三尖瓣收缩期的杂音（B错）。